患者女，55岁，10年来主要因丈夫有外遇，夫妻感情不佳，总想离婚，但又总舍不得孩子，又怕丢面子，来到心理咨询门诊，想问心理咨询师，离婚还是不离婚好此时心理咨询师最应注意采用的原则是
A. 回避原则
B. 中立原则
C. 耐心原则
D. 综合原则
E. 灵活原则

正确答案：B。中立原则

解析：心理治疗的基本原则有信赖性原则、整体性原则、发展性原则、个性化原则、中立性原则、保密性原则。中立性原则（B对）要求治疗者在心理治疗的过程中保持中立的态度和立场。治疗者对治疗中涉及的各类事件均应保持客观、中立的立场，不把个人的观点强加于患者。只有这样，治疗者才能对患者的情况进行客观分析，对其问题有正确的了解并有可能提出适宜的处理办法。此题中心力咨询师应该保持中立，更好地帮助患者理性分析问题。回避原则（A错）、耐心原则（C错）、综合原则（D错）、灵活原则（E错）均不是心理治疗的基本原则。